全身消炎药治疗牙周病主要用于
A. 牙周炎急性炎症期
B. 青春期龈炎
C. 龈缘炎
D. 增生性龈炎
E. 妊娠期龈炎

正确答案：A。牙周炎急性炎症期

解析：本题考查牙周病的药物治疗。全身消炎药治疗牙周病主要用于牙周炎急性炎症期（A对），有助于抗菌消炎，利于病损恢复。青春期龈炎（B错）、增生性龈炎（D错）、妊娠期龈炎（E错）是由于局部菌斑牙石的刺激、激素的变化或相关药物的服用引起，去除局部刺激因素如牙石菌斑为治疗关键，同时控制致病因素，必要时行牙龈成形术；全身用药效果不佳，尤其是妊娠期龈炎要避免全身用药，以免影响胎儿发育。